发现早期肺结核的主要方法是
A. 查痰抗酸杆菌
B. 胸部X线检查
C. 胸部CT
D. 痰菌检查
E. 血常规

正确答案：B。胸部X线检查

解析：本题考查发现早期肺结核的主要方法。胸部X线检查（B对ACDE错）是发现早期肺结核的主要方法，也是影像学诊断方法。